治疗消渴病肺热津伤证的主方为
A. 消渴方
B. 玉女煎
C. 六味地黄丸
D. 金匮肾气丸
E. 真武汤

正确答案：A。消渴方

解析：消渴病肺热津伤为肺脏燥热，津液失布所致，治宜清热润肺，生津止渴，方用消渴方（A对）。玉女煎为消渴病胃热炽盛证的代表方（B错）。六味地黄丸为消渴病肾阴亏损证的代表方（C错）。金匮肾气丸为消渴病阴阳两虚证的代表方（D错）。真武汤适用于脾肾阳虚，水气内停证（E错）。